下列哪种方法不适用于防治生物地球化学性疾病
A. 更换适宜的水源
B. 防止环境污染
C. 加强营养
D. 补充机体缺乏的元素
E. 对环境中过多元素进行降解

正确答案：B。防止环境污染

解析：本题考查生物地球化学性疾病的防治。生物地球化学性疾病是由于地壳表面化学元素分布的不均匀性，使某些地区的水和（或）土壤中某些元素过多或过少，当地居民通过饮水、食物等途径摄入这些元素过多或过少而引起某些特异性疾病，与环境污染没有关系，所以防止环境污染（B错，为本题正确答案）并不能防治生物地球化学性疾病。更换适宜的水源（A对）、加强营养（C对）、补充机体缺乏的元素（D对）、对环境中过多元素进行降解（E对）都适用于防治生物地球化学性疾病。